可作为气雾剂潜溶剂的是
A. 乙醇
B. 七氟丙烷
C. 聚山梨酯
D. 维生素C
E. 液状石蜡

正确答案：A。乙醇

解析：本题考查气雾剂的附加剂。乙醇（A对）可以作为气雾剂的潜溶剂；七氟丙烷（B错）可作为气雾剂的抛射剂；聚山梨酯（C错）可作为气雾剂的表面活性剂；维生素C（D错）可作为气雾剂的抗氧化剂；液体石蜡（E错）可作为乳膏剂等的油相基质。